短暂的一过性的意识障碍，一般不超过半小时，清醒后可有头痛、乏力，通常短期内会自行好转
A. 脑震荡
B. 脑挫裂伤
C. 急性颅内血肿
D. 颅骨骨折
E. 脑脊液漏口腔颌面部邻近颅脑，颌面伤常伴发颅脑损伤

正确答案：A。脑震荡

解析：脑震荡的典型临床特点为：短暂的一过性的意识障碍，一般不超过半小时，常伴有逆行性遗忘，清醒后可出现头痛、头晕、乏力、恶心和呕吐，通常短期内会自行好转。掌握“口腔颌面部创伤急救”知识点。